女，17岁。脑部受伤住院，入院后虽经积极救治，但3天后患者进入脑死亡状态。医师告知其父母，并建议撤掉呼吸机。其父母看到女儿在呼吸机支持下仍有呼吸，并能触及到女儿的脉搏，坚决不接受医师的建议，此时，该医师符合伦理的做法是
A. 尊重父母的意愿
B. 执行脑死亡标准并劝说其父母捐献患者器官
C. 直接撤掉呼吸机并填写死亡报告
D. 请公证机关来公证患者已经死亡
E. 向患者父母解释脑死亡，征得其同意后撤掉呼吸机

正确答案：E。向患者父母解释脑死亡，征得其同意后撤掉呼吸机

解析：脑死亡诊断标准的伦理价值和意义主要为五方面：科学准确判断死亡，维护逝者身后尊严，节约社会资源，减轻家庭负担，利于实施器官移植，基于这五点，医生应向患者父母解释脑死亡，征得其同意后撤掉呼吸机（E对）。